病毒性心肌炎气阴两虚证的用方是
A. 银翘散
B. 附子汤
C. 葛根芩连汤
D. 生脉散合复脉汤
E. 血府逐瘀汤合生脉散

正确答案：D。生脉散合复脉汤

解析：病毒性心肌炎之气阴亏虚证由热毒犯心，病久耗气伤阴，气阴亏虚所致，故治疗时应益气养阴，养心复脉，首选炙甘草汤合生脉散，复脉汤即炙甘草汤（D对）。银翘散（A错）其功用为辛凉透表，清热解毒，适用于病毒性心肌炎之风热犯心证。附子汤（B错）其功用为温经助阳，祛寒化湿，适用于肾阳虚衰兼水湿泛滥之证。葛根芩连汤（C错）其功用为解表清里，适用于病毒性心肌炎之湿热侵心证。血府逐瘀汤合生脉散（E错），血府逐瘀汤的功用为活血化瘀，行气止痛，生脉散的功用为益气生津，敛阴止汗，二者合用，适用于病毒性心肌炎之气虚血滞证。